可致不可逆性的骨髓功能抑制，引起再生障得性贫血，儿童需慎用的药物是
A. 氟喹诺酮类
B. 大环内酯类
C. 氨基糖苷类
D. 四环素类
E. 酰胺醇类(氯霉素）

正确答案：E。酰胺醇类(氯霉素）

解析：本题考查酰胺醇类(氯霉素）。可致不可逆性的骨髓功能抑制，引起再生障得性贫血，儿童需慎用的药物是酰胺醇类(氯霉素）（E对）。氟喹诺酮类（A错）可致肌痛、骨关节病损、跟腱炎症和跟腱断裂。大环内酯类（B错）可引起药疹和药物热，偶可引起过敏和暂时性耳聋，以及皮炎、会阴糜烂等，甚至休克。氨基糖苷类（C错）药物都有不同程度的耳毒性、肾毒性和神经肌肉阻滞作用。四环素类（D错）会选择性沉积在牙齿和骨骼中，不可用于8岁以下患儿。